改善教室的采光、照明、通风等属于
A. 学校健康教育
B. 学校卫生服务
C. 学校健康政策
D. 学校事物环境
E. 学校健康物质环境

正确答案：E。学校健康物质环境